下列气的生理功能，能控制汗液.唾液等液态物质分泌.排泄的是
A. 推动作用
B. 固摄作用
C. 防御作用
D. 气化作用
E. 中介作用

正确答案：B。固摄作用

解析：控制汗液、唾液等液态物质分泌，排泄是气的固摄作用的表现（B对）；推动作用指气中属阳部分（阳气）的激发、兴奋、促进等作用（A错）；防御作用指气既能护卫肌表，防御外邪入侵，同时也有祛除侵入人体内的病邪的作用（C错）；气化作用实际上是指由人体之气的运动而引起的精气血津液等物质与能量的新陈代谢过程（D错）；中介作用指气能感应传导信息以维系机体的整体联系的作用（E错）。